下列药物中，能燥湿止带的是
A. 防风
B. 白芷
C. 羌活
D. 苍耳子
E. 藁本

正确答案：B。白芷

解析：该题考查解表药的功效。防风功能祛风解表，胜湿止痛，止痉（A错）。白芷功能解表散寒，祛风止痛，通鼻窍，燥湿止带，消肿排脓（B对）。羌活功能解表散寒，祛风胜湿，止痛（C错）。苍耳子功能发散风寒，通鼻窍，祛风湿，止痛（D错）。藁本功能祛风散寒，除湿止痛（E错）。